氯沙坦的抗高血压机制是
A. 抑制肾素活性
B. 抑制血管紧张素转换酶活性
C. 抑制醛固酮的活性
D. 抑制血管紧张素Ⅰ的生成
E. 阻断血管紧张素受体生成

正确答案：E。阻断血管紧张素受体生成

解析：氯沙坦属于AT1受体拮抗剂，可选择性阻断AT1受体，竞争性阻断AngⅡ与AT1受体结合（E对），从而拮抗AngⅡ的缩血管作用及增强交感神经活性的作用，使血压下降，临床可用于各型高血压。卡托普利可抑制血管紧张素转换酶活性（B错），使AngⅠ生成AngⅡ减少，从而扩张血管，使血压下降，抑制肾组织中醛固酮的生成，水钠潴留减轻而降低血压，抑制缓激肽水解，增强扩张血管的作用。肾素可催化血管紧张素原转化形成AngⅠ；肾素抑制药则通过降低肾素活性（A错），进而抑制AngⅠ的生成（D错），降低血压。螺内酯属于醛固酮受体拮抗药，可抑制醛固酮的活性（C错），临床配合中高效利尿剂，治疗伴有醛固酮升高的顽固性水肿。